毛果芸香碱对眼的调节作用是
A. 睫状肌松弛，悬韧带拉紧，晶状体变扁平
B. 睫状肌松弛，悬韧带放松，晶状体变凸
C. 睫状肌收缩，悬韧带拉紧，晶状体变凸
D. 睫状肌收缩，悬韧带拉紧，晶状体变扁平
E. 睫状肌收缩，悬韧带放松，晶状体变凸

正确答案：E。睫状肌收缩，悬韧带放松，晶状体变凸